患者，男，78岁，表情呆滞，智力衰退，哭笑无常，喃喃自语，不思饮食，脘腹胀痛，痞满不适，口多涎沫，头重如裹，舌质淡，脉滑，其病证诊断是
A. 癫证心脾两虚证
B. 癫证痰气郁结证
C. 痴呆痰浊蒙窍证
D. 痴呆脾肾两虚证
E. 痫病风痰闭阻证

正确答案：C。痴呆痰浊蒙窍证

解析：根据患者“表情呆滞，智力衰退”，辨为“痴呆”，又由患者“不思饮食，脘腹胀痛，痞满不适，口多涎沫，头重如裹，舌质淡，脉滑”，辨为“痰浊蒙窍证”（C对）。患者痰浊上蒙，清窍被阻，神机失用，治宜健脾化浊，豁痰开窍，方选洗心汤加减。